Apgar评分，见皮肤有很多淤血，心率80次/min，弹足底有皱眉反应，四肢略屈曲，无呼吸。应评几分
A. 1
B. 4
C. 5
D. 3
E. 2

正确答案：D。3

解析：足月儿，阴道分娩，生后1min见皮肤有很多淤血（0分），心率80次/min（1分），弹足底有皱眉反应（1分），四肢略屈曲（1分），无呼吸（0分），应评为3分。